公正不仅指形式上的类似，强调公正的
A. 本质
B. 内容
C. 基础
D. 内涵
E. 意义

正确答案：B。内容

解析：公正原则是指以形式公正与内容公正的有机统一为依据分配和实现医疗和健康利益的伦理原则。公正既包括形式公正也包括内容公正，为形式公正与内容（B对）公正的有机统一。